脾脏中淋巴细胞聚集的部位是
A. 被摸
B. 白髓
C. 红髓
D. 脾索
E. 边缘区

正确答案：B。白髓